抑郁的主要临床表现中不包括
A. 情绪低落
B. 兴趣缺失
C. 心跳加快
D. 意志活动减少
E. 精力丧失

正确答案：C。心跳加快

解析：抑郁是以情绪低落、兴趣和快感缺失、意志活动减少、精力丧失为主要临床表现的综合征。C项心跳加快属于焦虑的表现。掌握“患者一般心理问题及不同年龄阶段患者心理”知识点。